转录就是
A. DNA依赖的DNA聚合酶催化
B. DNA依赖的RNA聚合酶催化
C. RNA依赖的DNA聚合酶催化
D. RNA依赖的RNA聚合酶催化
E. DNA为模板合成RNA的过程

正确答案：E。DNA为模板合成RNA的过程

解析：转录就是以DNA为模板合成RNA的过程。掌握“RNA的生物合成”知识点。